根据《麻醉药品和精神药品品种目录（2007年版）》属于麻醉药品的是
A. γ-羟丁酸
B. 西地那非
C. 麦角酸
D. 吗啡阿托品注射液
E. 阿普唑仑

正确答案：D。吗啡阿托品注射液

解析：本题考察特殊药品管理。根据《麻醉药品和精神药品品种目录（2007年版）》，属于麻醉药品的是吗啡阿托品注射液（D对）。